呈倒卵形，略似花瓶，外表红黄色或红棕色，有突起的刺状棕色小点的药材是
A. 栀子
B. 枸杞子
C. 山楂
D. 金樱子
E. 连翘

正确答案：D。金樱子

解析：本题考查的是金樱子药材的性状鉴别。呈倒卵形，略似花瓶，外表红黄色或红棕色，有突起的刺状棕色小点的药材是金樱子（D对）。金樱子：【性状鉴别】药材为花托发育而成的假果，呈倒卵形。表面红黄色或红棕色，有突起的棕色小点，系毛刺脱落后的残基。顶端有盘状花萼残基，中央有黄色柱基，下部渐尖。质硬。切开后内有多数坚硬的小瘦果，内壁及瘦果均有淡黄色绒毛。气微，味甘、微涩。栀子（A错）：【性状鉴别】药材呈长卵圆形或椭圆形。表面红黄色或棕红色，具6条翅状纵棱，棱间常有1条明显的纵脉纹，并有分枝。顶端残存萼片，基部稍尖，有残留果梗。果皮薄而脆，略有光泽；内表面色较浅，有光泽，具2～3条隆起的假隔膜。种子多数，扁卵圆形，集结成团，深红色或红黄色，表面密具细小疣状突起。气微，味微酸而苦。枸杞子（B错）：【性状鉴别】药材呈类纺锤形或椭圆形，表面红色或暗红色。顶端有小突起状的花柱痕，基部有白色的果梗痕。果皮柔韧，皱缩；果肉肉质，柔润。种子20～50粒，类肾形，扁而翘，表面浅黄色或棕黄色。气微，味甜。山楂（C错）：【性状鉴别】药材为圆形片，皱缩不平。外皮红色，具皱纹，有灰白小斑点。果肉深黄色至浅棕色。中部横切片具5粒浅黄色果核，但核多脱落而中空。有的片上可见短而细的果梗或花萼残迹。气微清香，味酸、微甜。连翘（E错）：【性状鉴别】药材呈长卵形至卵形，稍扁。表面有不规则纵皱纹和多数突起的小斑点，两面各有1条明显的纵沟。顶端锐尖，基部有小果梗或已脱落。青翘多不开裂，表面绿褐色，突起的灰白色小斑点较少；质硬；种子多数，黄绿色，细长，一侧有翅。老翘自顶端开裂或裂成两瓣，表面黄棕色或红棕色，内表面多为浅黄棕色，平滑，具一纵隔；质脆；种子棕色，多已脱落。气微香，味苦。